影响神经递质储存和释放的药物是
A. 麻黄碱
B. 维拉帕米
C. 氟尿嘧啶
D. 奥美拉唑
E. 去甲肾上腺素

正确答案：A。麻黄碱